患者，男，63岁。主因胸骨后疼痛2h入院，活动时加重，伴大汗、恶心。既往有高血压、冠心病史。体格检查：血压104/55mmHg,心率112次/min、呼吸31次/min、体温37.1℃，心律齐，各瓣膜区未闻及杂音，双肺呼吸音清，未闻及干湿性啰音，腹软，无压痛，反跳痛，双下肢轻度水肿。心电图示Ⅱ、Ⅲ、aVF导联出现ST段弓背上抬高，肌钙蛋白I升高。考虑目前患者诊断是
A. 急性下壁心肌梗死
B. 急性前间壁心肌梗死
C. 心源性休克
D. 肺栓塞
E. 气胸

正确答案：A。急性下壁心肌梗死

解析：患者老年男性，既往有高血压、冠心病史。现出现胸骨后疼痛，活动时加重，伴大汗、恶心（心肌梗死的常见症状），心电图示Ⅱ、Ⅲ、aVF导联（提示下壁心肌梗死）出现ST段弓背上抬高（急性心肌梗死特征性心电图改变），肌钙蛋白I（心肌梗死常见标记物）升高，综合患者的病史、临床表现、心电图表现和实验室检查，考虑目前患者诊断是急性下壁心肌梗死（A对）。急性前间壁心肌梗死（B错）会出现V1～V3导联ST段弓背上抬高。心源性休克（P244）（C错）收缩压低于80mmHg，有烦躁不安、面色苍白、皮肤湿冷、脉细而快等表现。肺栓塞（D错）患者常突发不明原因的呼吸困难及气促，并可伴胸痛、咳血等体征。气胸（P123）（E错）大多起病急骤，患者突感一侧胸痛，针刺样或刀割样，持续时间短暂，可伴有刺激性咳嗽。